血友病患者必须拔牙时，首要的处理原则是
A. 拔牙创内填塞止血材料
B. 注射止血药
C. 麻药中多量副肾素
D. 操作轻柔，减少创伤，缝合拔牙创
E. 术前、术后多次输新鲜血

正确答案：E。术前、术后多次输新鲜血

解析：本题考查血友病患者拔牙的首要的处理原则。血友病为一组遗传性凝血功能障碍的出血性疾病，共同特征为活性凝血酶生成障碍，凝血时间延长，终身皆有轻微创伤后就出血的倾向。血友病患者必须拔牙时，其首要处理原则是控制原发病，防止出血不止，必须在控制原发病的基础上才可以拔牙。可通过术前、术后多次输新鲜血（E对）补充活性凝血酶来控制原发病。拔牙创内填塞止血材料（A错）、注射止血药（B错）、麻药中多量副肾素（C错）、操作轻柔，减少创伤，缝合拔牙创（D错）等辅助措施都可以减少出血量，但必须是在控制原发病的基础上进行的，不是首要处理原则。